慢性胃炎患者，胃脘隐痛，嘈杂，口干咽燥，五心烦热，大便干结，舌红少津，脉细。治疗应首选的方剂是
A. 沙参麦冬汤
B. 生脉饮
C. 滋水清肝饮
D. 益胃汤
E. 玉女煎

正确答案：D。益胃汤

解析：慢性胃炎属于中医胃脘痛范畴，患者症见胃脘隐痛，嘈杂，口干咽燥，五心烦热，大便干结，舌红少津，脉细，辨证为胃阴不足证，治宜养阴益胃，和中止痛；方药用益胃汤加减（D对）。沙参麦冬汤具有干寒生津，清养肺胃的功效，主治燥伤肺胃或肺胃阴津不足，咽干口渴，或热，或干咳少痰（A错）。生脉饮具有益气复脉，养阴生津的功效，用于气阴两亏，心悸气短，脉微自汗的患者（B错）。滋水清肝饮具有滋阴养血，疏肝清热的功效，用于治疗阴虚肝郁，胁肋胀痛，胃脘疼痛等症（C错）。玉女煎具有清脏腑热，清胃热，滋肾阴的功效，主治胃热阴虚证（E错）。